牛黄的主要活性成分是
A. 去氧胆酸
B. 强心苷
C. 黄酮
D. 萜类化合物
E. 无机盐

正确答案：A。去氧胆酸

解析：本题考查的是牛黄的化学成分。牛黄的主要活性成分是去氧胆酸（A对）。牛黄约含8%胆汁酸，主要成分为胆酸、去氧胆酸和石胆酸。此外，还含有7%SMC及胆红素，胆固醇，麦角固醇，多种氨基酸（如丙氨酸、甘氨酸、牛磺酸、精氨酸、天冬氨酸、蛋氨酸等）和无机盐（E错）等。《中国药典》以胆酸和胆红素为牛黄的质量控制成分，要求胆酸含量不少于4.0%，胆红素含量不得少于25.0%。强心苷（B错）：强心苷是存在于生物界中的一类对心脏有显著生理活性的甾体苷类。主要分布于夹竹桃科、玄参科、百合科、萝藦科、十字花科、毛茛科和桑科等。黄酮（C错）：黄酮类化合物广泛存在于自然界中，多存在于高等植物及羊齿类植物中。苔类中含有的黄酮类化合物为数不多，而藻类、霉菌、细菌中没有发现黄酮类化合物。含黄酮类化合物的中药有黄芩、葛根、银杏叶、槐花、陈皮、满山红等。萜类化合物（D错）：是一类数量巨大、结构种类繁多、生物活性多样、具有很高药用价值的天然化学成分，在中药中分布极为广泛。如穿心莲、青蒿、龙胆、紫杉等众多中药的有效成分均为萜类化合物。